患者，男，25岁，爱上了比他大30多岁的婶婶，明知不能继续这种性关系，但不能摆脱，而来寻求治疗。对于该患者，首选的治疗方法可以为
A. 生物反馈
B. 精神分析
C. 放松训练
D. 眼动治疗
E. 系统脱敏

正确答案：B。精神分析